外感风寒，兼见胸闷不舒者，宜选用的药物是
A. 麻黄
B. 香薷
C. 菊花
D. 紫苏
E. 牛蒡子

正确答案：D。紫苏

解析：紫苏治疗风寒表证而兼气滞，胸脘满闷、恶心呕逆，或咳嗽痰多者（D对）。麻黄用于治疗外感风寒表实证、肺气壅遏所致喘咳胸闷、风水水肿（A错）。香薷多用于暑天感受风寒而兼脾胃湿困（B错）。菊花用于治疗风热感冒，温病初起、肝阳上亢，头痛眩晕、目赤肿痛，眼目昏花、疮痈肿毒（C错）。牛蒡子治疗风热感冒，温病初起，咳嗽痰多、麻疹不透，风疹瘙痒、痈肿疮毒，丹毒，痄腮，咽喉肿痛（E错）。